某男患者，65岁。患胃癌四年，晚期，已失去手术治疗价值，生命垂危。家属再三恳求医生，希望能满足病人心理上的渴求，收他入院。医生出于“人道”，将他破格地收入院。究竟该不该收治这个病人。从病人的权利分析，应该收治的理由是
A. 解除疾病痛苦是患者的基本需要
B. 病人有权享有必要的、合理的、基本的诊治护理权利
C. 人类的生存权利是平等的，因而医疗保健的享有权也是平等的
D. 对待各种疾病的患者，应一视同仁
E. 以上都是

正确答案：E。以上都是